有关脑膜中动脉的描述，错误的是
A. 为上颌动脉的分支
B. 穿卵圆孔进入颅中窝
C. 入颅后分为前、后二支
D. 前支经翼点（区）内面
E. 受损后易形成颅内血肿

正确答案：B。穿卵圆孔进入颅中窝

解析：脑膜中动脉为上颌动脉的分支（A对）。向上穿棘孔（B错，为本题正确答案）进入颅腔。入颅后分为前、后二支（C对）。前支行经颅骨翼点的内面（D对）。受损后易形成颅内血肿（E对）。